气血虚弱证闭经的首选方是
A. 八珍汤
B. 圣愈汤
C. 十全大补汤
D. 人参养荣汤
E. 人参滋血汤

正确答案：D。人参养荣汤

解析：闭经气血虚弱型，治法益气养血调经，方药人参养荣汤，原方治劳积虚损，呼吸少气，心虚惊悸，脾肺气虚，气血两亏者，（D对）。八珍汤主治益气补血，主治气血两虚（A错）。圣愈汤补气，补血，摄血，主治诸恶疮血出过多，心烦不安，不得睡眠（B错）。十全大补汤功能温补气血，治诸虚不足（C错）。人参滋血汤益气养血，滋荣养血，调理脾胃（E错）。